女，29岁，结婚3年未避孕未孕，月经无痛，实验室检查：外阴发育正常，阴道通畅。子宫大小正常，质中，无压痛，未触及包块，连续3年体温呈单相型，TSH3.2mU/L，不孕的原因为
A. 子宫颈因素
B. 宫颈管因素
C. 甲状腺因素
D. 子宫体因素
E. 排卵功能障碍

正确答案：E。排卵功能障碍

解析：该患者女，29岁，结婚3年未避孕未孕，月经无痛，实验室检查：外阴发育正常，阴道通畅。子宫大小正常，质中，无压痛，未触及包块，连续3年体温呈单相型，TSH3.2mU/L，结合该患者的表现提示为不孕症，无排卵性基础体温呈单相型，故不孕的原因为排卵功能障碍（E对）。